因毛细血管通透性增加而致胸腔积液的疾病是
A. 肾病综合征
B. 肝硬化
C. 类风湿关节炎
D. 左心衰竭
E. 缩窄性心包炎

正确答案：C。类风湿关节炎

解析：胸腔积液是指胸腔内液体产生增多或吸收减少，超出正常范围的一种病理改变。由毛细血管壁通透性增加引起的胸腔积液常见的病因有：胸膜炎症（肺结核、肺炎）、风湿性疾病[系统性红斑狼疮（SLE）、类风湿性关节炎（RA）（C对）]、胸膜肿瘤（恶性肿瘤转移、间皮瘤）、肺梗死、膈下炎症（膈下脓肿、肝脓肿、急性胰腺炎）等；充血性心力衰竭（D错）和缩窄性心包炎（E错）时，由于胸膜毛细血管内静水压增高，导致有效滤过压增大，组织液生成过多，引起漏出性胸腔积液；肝硬化（B错）和肾病综合征（A错）时，由于胸膜毛细血管内胶体渗透压降低，导致有效滤过压增大，组织液生成过多，引起漏出性胸腔积液。